维生素B₁在体内的生物活性形式是
A. 硫胺焦亚硫酸酯
B. 硫胺单磷酸酯
C. 硫胺三磷酸酯
D. 硫胺焦磷酸酯
E. 硫胺硫酸酯

正确答案：D。硫胺焦磷酸酯

解析：本题考查维生素B₁的代谢。维生素B₁被人体吸收后，转变为有生物活性的硫胺焦磷酸酯（D对），是脱羧辅酶的组成部分，参与维持正常的糖代谢及神经、心脏系统功能。硫胺焦亚硫酸酯（A错）、硫胺单磷酸酯（B错）、硫胺三磷酸酯（C错）、硫胺硫酸酯（E错）都不是维生素B₁在体内的生物活性形式，与题意无关。